有关奥美拉唑的叙述，错误的是
A. 口服后，浓集于壁细胞分泌小管周围
B. 代谢成次磺酸和亚磺酰胺后失活
C. 能够不可逆的抑制H泵的作用
D. 不影响胃蛋白酶的分泌
E. 不影响内因子的分泌

正确答案：B。代谢成次磺酸和亚磺酰胺后失活